以下药物的含量测定方法为：肾上腺素
A. 非水溶液滴定法
B. 双相滴定法
C. 溴量法
D. 亚硝酸钠滴定法
E. 沉淀滴定法

正确答案：A。非水溶液滴定法

解析：本题考查非水溶液滴定法。非水溶液滴定法（A对）是以质子传递反应为基础的在水以外的溶剂中滴定的方法，主要用来测定有机碱及其氢卤酸盐、磷酸盐、硫酸盐或 有机酸盐、以及有机酸碱金属盐类药物的含量, 也用于测定某些有机弱酸的含量。肾上腺素含氨基显弱碱性，采用非水溶液滴定法。双相滴定法（B错）采用两种互不相溶的溶剂在分液漏斗中进行的滴定，比如苯甲酸钠。碘量法（C错）：碘可做为氧化剂而被中强的还原剂所还原；碘离子也可做为还原剂而被中强的或强的氧化剂所氧化。亚硝酸钠滴定法（D错）：亚硝酸钠在盐酸存在条件下与具有芳伯氨基化合物发生重氮化反应，定量生成重氮盐。根据亚硝酸钠的消耗量可计算出药物有效成分的含量。沉淀滴定法（E错）是以沉淀反应为基础的一种滴定分析方法。